乏氧性缺氧时氧离曲线右移的最主要的原因是
A. 红细胞内2,3-DPG浓度升高
B. 血液H+浓度升高
C. 血液二氧化碳分压升高
D. 血液温度升高
E. 一氧化碳中毒

正确答案：A。红细胞内2,3-DPG浓度升高

解析：在高原，随着海拔的升高，大气压下降，吸入气氧分压也相应降低，致使肺泡气氧分压降低，从而引起乏氧性缺氧。从平原进入高原后，红细胞内2，3-DPG含量迅速增高，返回平原后迅速恢复，可见乏氧性缺氧时主要引起红细胞内2，3-DPG的升高，而红细胞内2，3-DPG升高（A对）使氧离曲线右移。血液H+浓度升高（B错）、血液二氧化碳分压升高（C错）、血液温度升高（D错）虽然都可以使氧离曲线右移，但与题意不符。一氧化碳中毒（E错）可以引起乏氧性缺氧，但它使氧离曲线左移。